高肾素型高血压病宜选用的药物是
A. 氢氯噻嗪
B. 卡托普利
C. 肼屈嗪
D. 硝苯地平
E. 尼群地平

正确答案：B。卡托普利

解析：卡托普利适用于各种类型高血压，对原发性高血压和肾性高血压较好，尤其适用于伴有慢性心功能不全、缺血性心脏病或糖尿病所致肾病的高血压病人（B对）。